肝十二指肠韧带内有
A. 胆囊管、肝固有动脉和肝门静脉
B. 肝总管、肝静脉和肝门静脉
C. 胆总管、肝固有动脉和肝静脉
D. 胆总管、肝固有动脉和肝门静脉
E. 胆囊管、肝固有动脉和肝静脉

正确答案：D。胆总管、肝固有动脉和肝门静脉

解析：肝十二指肠韧带内有右前方胆总管、左前方肝固有动脉及后方肝门静脉(D对)。